地方性甲状腺肿的最主要病因是
A. 饮水中缺碘
B. 摄碘量不足或过高
C. 促甲状腺肿物质增加
D. 遗传缺陷
E. 先天性甲状腺功能低下

正确答案：A。饮水中缺碘

解析：本题考查地方性甲状腺肿的最主要病因。地方性甲状腺肿是一种主要由于地区性环境缺碘引起的地方病。碘缺乏是引起本病流行的主要原因。国内外许多流行病学调查资料显示，绝大多数地方性甲状腺肿流行区的饮水、食物及土壤中，碘均缺乏或不足（A对BCDE错）。碘含量与地方性甲状腺肿患病率呈现负相关。